由腺泡样细胞、闰管样细胞、空泡状细胞、透明细胞和非特异性腺样细胞构成实质的唾液腺恶性上皮性肿瘤是
A. 恶性多形性腺瘤
B. 腺泡细胞癌
C. 黏液表皮样癌
D. 腺样囊性癌
E. 多形性低度恶性腺癌

正确答案：B。腺泡细胞癌

解析：腺泡细胞癌是唾液腺恶性上皮性肿瘤，镜下见肿瘤实质细胞特有腺泡样细胞、闰管样细胞、空泡样细胞、透明细胞和非特异性腺样细胞。掌握“腺泡细胞癌”知识点。